患者，男，67岁，慢性胰腺炎，餐后上腹胀，进食油腻食物后明显，近1年体重明显下降，大便中有油滴，宜选用的药物是
A. 艾司奥美拉唑
B. 铝碳酸镁
C. 法莫替丁
D. 复方消化酶
E. 多潘立酮

正确答案：D。复方消化酶

解析：本题考查复方消化酶。患者，男，67岁，慢性胰腺炎，餐后上腹胀，进食油腻食物后明显，近1年体重明显下降，大便中有油滴，宜选用的药物是复方消化酶（D对）。胰腺分泌功能不足或由于胃肠、肝胆疾病引起的消化酶不足者可以胰酶片、多酶片。艾司奥美拉唑（A错）和法莫替丁（C错）为抑酸剂。铝碳酸镁（B错）为抗酸剂。多潘立酮（E错）为促动力药。